属呼吸链中的酶是
A. 6-磷酸葡萄糖脱氢酶
B. 苹果酸脱氢酶
C. 丙酮酸脱氢酶
D. NADH脱氢酶
E. 葡萄糖-6-磷酸酶

正确答案：D。NADH脱氢酶

解析：属呼吸链中的酶是NADH脱氢酶（D对），又称NADH-泛醌还原酶，它可以接受来自NADH+H⁺的电子并转移给泛醌。6-磷酸葡萄糖脱氢酶（A错）属磷酸戊糖通路中的酶。苹果酸脱氢酶（B错）属三羧酸循环中的酶。丙酮酸脱氢酶（C错）属糖有氧氧化途径中的酶。葡萄糖-6-磷酸酶（E错）属糖异生中的酶。